局部振动病是指长期使用振动工具而引起的
A. 前庭器官障碍
B. 视觉紊乱
C. 以末梢循环障碍为主的疾病
D. 骨骼肌肉损伤
E. 免疫功能低下

正确答案：C。以末梢循环障碍为主的疾病